男，54岁，有糖尿病史，近几年因工作紧张患高血压：22/13.6kPa。最好选用哪种降压药
A. 氢氯噻嗪
B. 可乐定
C. 氯沙坦
D. 硝苯地平
E. 利血平

正确答案：C。氯沙坦

解析：氯沙坦属于血管紧张素受体（AT1）拮抗剂，有选择性阻断AT1的作用，对高血压、糖尿病合并肾功能不全患者也有保护作用，能够促进肾脏尿酸排泄，并可以抑制左室心肌肥厚和血管壁增厚。掌握“抗高血压药”知识点。